控制普通型疟疾发作多选用的药物是
A. 乙胺嘧啶
B. 氯喹
C. 奎宁
D. 哌喹
E. 伯氨喹

正确答案：B。氯喹

解析：控制普通型疟疾发作多选用的药物是氯喹（B对），它是目前非耐药疟疾的首选。乙胺嘧啶（A错）属于抗叶酸类药物，通常用作联合用药治疗。乙奎宁（C错）用于耐氯喹疟原虫株感染患者。哌喹（D错）主要控制疟疾症状，对于抗氯喹性恶性疟有根治作用，但作用缓慢，宜在奎宁，青蒿素类或咯萘啶控制症状后续用本品，并非首选。伯氨喹（E错）是目前唯一可供使用的预防复发和传播的药物。